为了使某些药物给药后能迅速达到或接近稳态血药浓度以快速发挥药效，临床可采取的给药方式是
A. 先静脉注射一个负荷剂量，再恒速静脉滴注
B. 加快静脉滴注速度
C. 多次间隔静脉注射
D. 单次大剂量静脉注射
E. 以负荷剂量持续滴注

正确答案：A。先静脉注射一个负荷剂量，再恒速静脉滴注

解析：本题考查负荷剂量。为了使某些药物给药后能迅速达到或接近稳态血药浓度以快速发挥药效，临床可采取的给药方式是先静脉注射一个负荷剂量，再恒速静脉滴注（A对）。在临床应用中为了能迅速达到或接近稳态血药浓度Css以便快速发挥药效，在静脉滴注开始时往往需要静脉注射一个负荷剂量，同时联合静脉滴注来维持Css。